男，46岁，腹痛2年，加重2周，其余生命体征正常，有压痛，反跳痛，肌紧张，肝脏检查阴性。余均正常。引起腹痛的原因
A. 急性心肌梗死
B. 急性胰腺炎
C. 消化性溃疡
D. 急性冠心病
E. 急性胃粘膜病变

正确答案：C。消化性溃疡

解析：根据题意应诊断为消化性溃疡并穿孔（肝脏检查阴性），目前体征有压痛、反跳痛并出现肌紧张，已引起了腹膜炎，所以会引起腹痛（C对）。急性心肌梗死、急性冠心病会出现胸闷、胸前区压榨感（AD错）。急性胰腺炎会出现左侧上腹部疼痛，会牵扯后背部疼痛，同时腹部会出现相应体征（B错）。根据患者腹痛已有2年时间，此次加重2周，未喝酒、未服用非甾体止痛药，所以可排除急性胃粘膜病变（E错）。